47岁男性。上颌前牙固定修复3年，现出现松动，咬合疼痛。口腔检查：左上2缺失，左上123烤瓷固定桥修复，左上13为烤瓷全冠固位体，边缘均不密合。左上1远中和左上3的近中邻面可探及深龋，左上3叩诊（++），牙龈红肿，无牙周袋。余牙健康，咬合正常。治疗前最需做的辅助检查是基牙的X线检查。原固定修复体松动原因是原固定修复体边缘不密合。拆除不良修复体后应先做
A. 左上3根管治疗
B. 洁治
C. 左上1拔除
D. 左上3拔除
E. 左上1根管治疗

正确答案：A。左上3根管治疗

解析：本题考查修复前的准备及处理。对于龋病应根据牙髓情况分别进行充填治疗、根管治疗（A对）。洁治（B错）用于牙周疾病的治疗。一般来说,对于牙槽骨吸收达到根2/3以上，牙松动达Ⅲ度者予以拔除；对未达到这一严重程度的松动牙，经有效治疗后尽量予以保留；某些残根，如牙槽骨高度正常、根面至少齐龈、经完善的根管治疗后、可利用其做根内固位体的基牙或者覆盖基牙者，均应保留（CD错）。